不产生内生致热原的细胞是
A. 单核细胞
B. 巨噬细胞
C. 心肌细胞
D. 淋巴细胞
E. 星状细胞

正确答案：C。心肌细胞

解析：能产生内生致热原的细胞有单核细胞（A对）、巨噬细胞（B对）、内皮细胞、淋巴细胞（D对）、星状细胞（E对）以及肿瘤细胞等，不包括心肌细胞（C错，为本题正确答案）。